饥饿时分解代谢可产生酮体的物质是
A. 维生素
B. 脂肪酸
C. 核苷酸
D. 葡萄糖
E. 氨基酸

正确答案：B。脂肪酸